保守医疗秘密之两方面的内容是指
A. 为病人保密与对病人保密
B. 为病人保密与对病人家属保密
C. 为病人家属保密与对病人保密
D. 为病人家属保密与对病人家属保密
E. 为医院保密与对同事保密

正确答案：A。为病人保密与对病人保密